环境健康影响评价的英文简称是
A. EHIA
B. EHEA
C. EHEE
D. EHIE
E. CHIE

正确答案：A。EHIA

解析：本题考查环境健康影响评价的英文简称。环境健康影响评价的英文简称是EHIA（A对BCDE错）。环境健康影响评价是预测、分析和评估由规划和建设项目实施后可能造成的环境质最变化而带来的人群健康影响及其安全性。